白芍具有的功效是
A. 补益精血，润肠通便
B. 补血养阴，润肺止咳
C. 平抑肝阳，柔肝止痛
D. 养阴润肺，益胃生津
E. 滋阴潜阳，清心除烦

正确答案：C。平抑肝阳，柔肝止痛

解析：该题考查白芍的功效，属记忆内容。白芍味苦、酸，性微寒；入肝、脾经；具有养血敛阴，柔肝止痛，平抑肝阳的功效（C对ABDE错）。